癸烷（C₁₀H₃₂）无麻醉作用
A. 在碳原子相同的情况下直链饱和烃＞支链饱和烃
B. 随着碳原子数目增加，麻醉作用增强
C. 9个碳原子以上毒性减弱
D. 有机磷结构式中的2-乙基被2-乙氧基取代后毒性增强
E. 成环的烃类毒性＞不成环的烃类毒性

正确答案：C。9个碳原子以上毒性减弱

解析：本题考查同系物的碳原子数和结构对毒性的影响。癸烷（C₁₀H₃₂）无麻醉作用，说明9个碳原子以上毒性减弱（C对ABDE错）。